应该进行整体高温化制的病畜是
A. 瘟猪
B. 水疱病畜
C. 炭疽病畜
D. 囊虫病畜
E. 布氏杆菌病畜

正确答案：C。炭疽病畜